血分热盛可见
A. 强硬舌
B. 瘦舌
C. 点刺舌
D. 歪斜舌
E. 老舌

正确答案：C。点刺舌

解析：血分热盛，热郁舌內，蕈状乳头增生，数目增多，充血肿大而形成点刺舌（C对）。强硬舌多因外感热病，邪入心包，扰乱心神，致舌无主宰；或高热伤津，筋脉失养，使舌体失去柔和之性，故见强硬。或肝风夹痰，风痰阻滞舌体脉络等，亦可使舌体强硬不灵（A错）。瘦舌由气血阴液不足，不能充盈舌体，舌失濡养所致（B错）。歪斜舌多因肝风内动，夹痰或夹瘀，痰淤阻滞一侧经络，以致舌肌弛缓，收缩无力，故伸舌时舌体歪向一侧（D错）。老舌由实邪亢盛，充斥体内，而正气未衰，邪正交争，邪气雍滞于上所致（E错）